某妇女的末次月经是在2003年11月30日。她的月经周期可能是
A. 3～5天
B. 4～6天
C. 13天
D. 15天
E. 29天

正确答案：E。29天

解析：本题考查女性生殖系统生理。某妇女的末次月经是在2003年11月30日。她的月经周期可能是29天（E对）。月经周期一般为21～35日，平均28日。